目前我国预防地方性碘缺乏病的最主要措施是
A. 增加食物中碘的比例
B. 提倡用碘油
C. 多吃海带
D. 供给碘化食盐
E. 改善居住环境

正确答案：D。供给碘化食盐

解析：本题考查我国预防地方性碘缺乏病的最主要措施。碘缺乏病是指从胚胎发育至成人期由于碘摄入量不足而引起的一系列病症。目前我国预防地方性碘缺乏病的最主要措施是供给碘化食盐（D对ABCE错）。食盐加碘是预防碘缺乏病的首选方法，实践证明，食盐加碘是最易坚持的有效措施，而且简便、经济、安全可靠。